既攻毒蚀疮，又破血逐瘀的药是
A. 砒石
B. 斑蝥
C. 升药
D. 干漆
E. 猫爪草

正确答案：B。斑蝥

解析：本题考查的是斑蝥的功效。既攻毒蚀疮，又破血逐瘀的药是斑蝥（B对）。斑蝥：【功效】攻毒蚀疮，破血逐瘀，散结消癥。砒石（A错）：【功效】外用蚀疮去腐；内服劫痰平喘，截疟。升药（C错）：【功效】拔毒去腐。干漆（D错）：【功效】破血祛瘀，杀虫。猫爪草（E错）：【功效】化痰散结，解毒消肿。